小儿腹泻时传统口服补液盐（ORS）的电解质渗透压，张力约为
A. 1/4张
B. 1/3张
C. 2/5张
D. 1/2张
E. 2/3张

正确答案：E。2/3张

解析：本题考查儿童营养基础。口服补液盐（ORS）传统配方：每袋粉剂含氯化钠3.5g，碳酸氢钠2.5g，枸橼酸钾1.5g，葡萄糖20.0g，每袋加温开水至1000ml即可。其电解质渗透压为220mOsm/L，张力约为2/3张（E对），总渗透压为310mOsm/L。